社区口腔卫生服务的任务包括
A. 提高人群口腔健康水平
B. 提供基本口腔卫生服务
C. 满足社区日益增长的口腔卫生服务需求
D. 营造口腔健康社区
E. 以上均包括

正确答案：E。以上均包括

解析：社区口腔卫生服务的任务：提高人群口腔健康水平、改善生活质量；提供基本口腔卫生服务、满足社区居民日益增长的口腔卫生服务需求；营造口腔健康社区；保证区域卫生规划的实施、保证医疗卫生体制改革和城镇职工基本医疗保险制度改革的实施；完善社区口腔卫生服务机构的功能。掌握“社区口腔卫生服务”知识点。